丙硫氧嘧啶抗甲状腺作用的机理包括
A. 抑制甲状腺过氧化物酶，阻止碘离子氧化
B. 降低促甲状腺素（TSH）分泌
C. 不影响已合成的T₃、T₄释放与利用
D. 破坏甲状腺组织
E. 在周围组织中抑制T₄转化成T₃

正确答案：A、C、E。抑制甲状腺过氧化物酶，阻止碘离子氧化；不影响已合成的T₃、T₄释放与利用；在周围组织中抑制T₄转化成T₃

解析：本题考查丙硫氧嘧啶的作用机制。丙硫氧嘧啶抗甲状腺作用的机理包括抑制甲状腺过氧化物酶，阻止碘离子氧化（A对）；不影响已合成的T₃、T₄释放与利用（C对）；在周围组织中抑制T₄转化成T₃（E对）。血循环中甲状腺激素过多而引起的以神经、循环、消化等系统兴奋性增高和代谢亢进为主要表现的一组临床综合征，称为甲状腺毒症。由于甲状腺腺体本身功能亢进，合成和分泌甲状腺激素增加所导致的甲状腺毒症称为甲状腺功能亢进症，简称甲亢。丙硫氧嘧啶能抑制过氧化酶系统，使被摄入到甲状腺细胞内的碘化物不能氧化成活性碘，酪氨酸不能碘化；同时，一碘酪氨酸和二碘酪氨酸的缩合过程受阻，以致不能生成甲状腺激素。由于本品不能直接对抗甲状腺激素，不影响I⁻的摄入及已合成的T₄和T₃的释放和利用，故需待已有的T₄和T₃耗竭后，才出现抗甲状腺激素的作用，故作用较慢。本品在甲状腺外能抑制T₄转化为T₃，与其疗效亦有关系。丙硫氧嘧啶不但不降低促甲状腺激素（TSH）的分泌，反而会使TSH分泌增多（B错），使腺体增生。本品也不破坏甲状腺组织（D错）。